颈外动脉和颈内动脉鉴别要点中不包括
A. 颈内动脉初在颈外动脉的后外侧，继在后内侧
B. 颈内动脉在颈部无分支
C. 颈外动脉在颈部发出一系列分支
D. 暂时阻断颈外动脉同时触摸颞浅动脉时无搏动
E. 颈内动脉比颈外动脉粗

正确答案：E。颈内动脉比颈外动脉粗

解析：本题考查颈外动脉和颈内动脉的鉴别要点。一般情况下，颈内动脉血管径比颈外动脉粗（E错，为本题的正确答案），但因情况而异，不能作为鉴别要点。颈外动脉和颈内动脉鉴别要点：在颈动脉三角内，颈内动脉先位于颈外动脉的后外侧，此后颈内动脉上行于颈外动脉的后内侧（A对）；颈内动脉在颈部无分支（B对），进入颅内才有分支，颈外动脉在颈部发出一系列分支（C对），这是两者最明显的区别；暂时阻断颈外动脉同时触摸颞浅动脉时无搏动（D对），这是由于颈外动脉行至下颌骨髁突颈部与外耳道之间时，分为颌内动脉和颞浅动脉两个终末支。